患者身热，微恶风，汗少，肢体酸重，头昏重胀痛，咳嗽痰黏，鼻流浊涕，心烦，口渴，舌苔薄黄而腻，脉濡数。治疗应首选
A. 银翘散
B. 桑菊饮
C. 新加香薷饮
D. 桑白皮汤
E. 藿香正气散

正确答案：C。新加香薷饮

解析：题中患者以身热，微恶风，汗少，肢体酸楚，咳嗽痰黏，鼻流浊涕为主症，故诊断为感冒。身热，微恶风，汗少，肢体酸楚为暑湿伤表，卫表不和所致；暑湿犯肺，肺气不清，咳嗽痰黏，鼻流浊涕；风暑夹湿上犯，故头昏重胀痛；暑热内扰，热灼津伤，故心烦口渴；舌苔薄黄而腻，脉濡数为暑热夹湿之象，故辨为暑湿伤表证。银翘散功能辛凉解表，清热解毒，为感冒风热犯表证的选方（A错）。桑菊饮功能疏风清热，宣肺止咳，为咳嗽风热咳嗽的选方（B错）。题中辨证为感冒暑湿伤表证，治宜清暑祛湿解表，首选新加香薷饮（C对）。桑白皮汤清热肃肺化痰，适用于痰热郁肺证（D错）。藿香正气散功能解表化湿，理气和中，主治外感风寒，内伤湿滞证（E错）。